耻骨联合上缘至股骨内上髁上缘的骨度分寸是
A. 18 寸
B. 19寸
C. 20 寸
D. 21 寸
E. 22 寸

正确答案：A。18 寸

解析：耻骨联合上缘至股骨内上髁上缘的骨度分寸为18寸（A对）。股骨大转子至腘横纹的骨度分寸为19寸（B错）。常用骨度分寸无20寸、21寸、22寸（CDE错）。